既祛风湿、舒筋络，又清虚热的药是
A. 木瓜
B. 秦艽
C. 独活
D. 防己
E. 防风

正确答案：B。秦艽

解析：本题考查秦艽的功效。既祛风湿、舒筋络，又清虚热的药是秦艽（B对）。秦艽【功效】祛风湿，舒筋络，清虚热，利湿退黄。木瓜（A错）【功效】舒筋活络，化湿和中，生津开胃。独活（C错）【功效】祛风湿，止痛，解表。防己（D错）【功效】祛风湿，止痛，利水。防风（E错）【功效】祛风解表，胜湿，止痛，解痉。